小儿体格发育的两个高峰期是
A. 婴儿期、学龄期
B. 学龄前期、青春期
C. 幼儿期、学龄期
D. 婴儿期、青春期
E. 新生儿期、学龄期

正确答案：D。婴儿期、青春期

解析：婴儿期和青春期（D对）是小儿体格发育的两个高峰期。